不愿重返原来的生活环境指
A. 角色行为异常
B. 角色行为冲突
C. 角色行为适应
D. 角色行为强化
E. 角色行为减退

正确答案：D。角色行为强化

解析：角色行为强化：角色强化多发生在由患者角色向常态角色转化时。由于适应了患者的生活，产生了对疾病的习惯心理，即按时打针、吃药，按医嘱办事成了自己的行为模式；也可以是患病前后的环境、生活内容反差较大。虽然躯体疾病已康复，但患者的依赖性加强和自信心减弱，对承担原来的社会角色恐慌不安，心理上产生了“衰弱感”或想继续享受“舒适感”，安心于已适应的患者生活模式，不愿重返原来的生活环境。掌握“患者角色和求医行为”知识点。